第二腰椎棘突下旁开1.5是
A. 肾俞
B. 肺俞
C. 肝俞
D. 膈俞
E. 三焦俞

正确答案：A。肾俞

解析：肾俞定位第2腰椎棘突下，旁开1.5寸（A对）。肺俞定位第3胸椎棘突下，旁开1.5寸（B错）。肝俞定位第9胸椎棘突下，旁开1.5寸（C错）。膈俞定位第7胸椎棘突下，旁开1.5寸（D对）。三焦俞定位第1腰椎棘突下，旁开1.5（E错）。